老年男性发生膀胱结石最常见的诱因是
A. 膀胱炎
B. 前列腺炎
C. 前列腺增生
D. 膀胱憩室
E. 膀胱异物

正确答案：C。前列腺增生

解析：膀胱结石分为原发性结石和继发性结石。原发性膀胱结石多见于营养不良的幼儿；继发性膀胱结石多发生于成年人，多与下尿路梗阻有关。良性前列腺增生为引起老年男性尿路梗阻最常见的原因，因此，老年男性发生膀胱结石最常见的诱因是前列腺增生（C对）。膀胱炎（A错）、前列腺炎（B错）、膀胱憩室（D错）和膀胱异物（E错）亦可诱发膀胱结石，但发生率相对较低。